男，45岁。车祸致左枕部着地，当即意识丧失，送至附近医院途中右侧肢体间断性抽搐伴喷射性呕吐3次。查体：P56次/分，BP160/95mmHg，浅昏迷、躁动，右侧瞳孔直径约4mm，左侧2mm；对光反射：左侧存优先。采取的处理措施是
A. 给予消炎药和神经营养药
B. 适量输液和给予脱水剂
C. 注射止血剂和输血
D. 制动并注射镇静剂
E. 维持呼吸道通畅

正确答案：B。适量输液和给予脱水剂

解析：中年男性患者，车祸致左枕部着地，当即意识丧失，送至附近医院途中右侧肢体间断性抽搐伴喷射性呕吐3次（颅内压增高）。查体：P56次/分（正常值60～100次/分），BP160/95mmHg（正常值90～120/60～80mmHg），浅昏迷、躁动，右侧瞳孔直径约4mm（正常值2～4mm），左侧2mm；对光反射：左侧存优先。综合患者的症状、体征和辅助检查，初步诊断为右额急性硬脑膜下血肿伴右小脑幕切迹疝。脑疝是由于急剧的颅内压增高造成的，采取的处理措施是适量输液和给予脱水剂（B对）。给予消炎药和神经营养药（A错）、制动并注射镇静剂（D错）、维持呼吸道通畅（E错）为对症治疗。患者无休克表现，无需注射止血剂和输血（C错）。